上颌神经、下颌神经出颅的解剖标志分别是
A. 圆孔、卵圆孔
B. 卵圆孔、圆孔
C. 棘孔、圆孔
D. 棘孔、卵圆孔
E. 棘孔、下颌孔

正确答案：A。圆孔、卵圆孔

解析：本题考查蝶骨、颞骨及舌骨的解剖特点。蝶骨大翼的大脑面近蝶骨体处的前内侧有圆孔，向前通翼腭窝，三叉神经的分支——上颌神经由此出颅；圆孔的后外侧为卵圆孔，向下通颞下窝，三叉神经的分支——下颌神经由此出颅（A对）；再向后外侧是较小的棘孔，脑膜中动脉由此入颅。